能全部通过六号筛，但混有能通过七号筛不超过95%的粉末是
A. 最粗粉
B. 粗粉
C. 细粉
D. 最细粉
E. 极细粉

正确答案：D。最细粉